作为机体获得对HBV免疫力及乙型肝炎患者痊愈的指标是
A. HBsAg（+）
B. 抗-HBs（+）
C. HBeAg（+）
D. 抗-HBc（+）
E. 抗-HBe（+）

正确答案：B。抗-HBs（+）

解析：HBsAg（A错）是HBV感染的血清学标志，HBV感染后早至1～2周，迟则11～12周可检出，急性自限性肝炎于6个月内消失，在无症状携带者或慢性乙型肝炎患者中HBsAg可持续存在多年，甚至终生。抗-HBs阳性（B对）见于HBV感染恢复和乙肝疫苗免疫接种成功，对HBV再感染具有保护作用。HBeAg（C错）为HBV感染后与HBsAg同时或稍后出现的血清学标志，是病毒复制的重要指标。急性自限性肝炎时，HBeAg多于10周内消失而产生抗-HBe（E错），慢性HBV感染者中每年约10%可发生HBeAg血清学转换（seroconversion），提示HBV复制减弱或趋于停止。HBeAg存在于HBV颗粒的核心及感染的肝细胞核内，血液中不易检出，但其抗原性强，于感染后早期即可刺激机体产生抗-HBc（D错），抗-HBcIgM为急性感染及慢性感染病情活动的标志，抗-HBcIgG出现较迟，见于急性感染恢复期和慢性感染期。